关于心左缘的构成，正确的是
A. 左心房
B. 左心室
C. 左心室与左心房
D. 左心室与左心耳
E. 肺动脉与左心耳

正确答案：D。左心室与左心耳

解析：左心室与左心耳（D对）构成心左缘。右心房构成心右缘。右心室和心尖构成心下缘。